牙槽突裂植骨术的时机主要是依据
A. 单侧还是双侧
B. 裂隙宽度大小
C. 患者发育情况
D. 正畸治疗基本完成
E. 手术侧恒尖牙未萌，牙根形成2/3

正确答案：E。手术侧恒尖牙未萌，牙根形成2/3

解析：本题考查牙槽突裂植骨术的时机。牙槽突裂手术包括软组织裂隙或瘘口关闭和骨组织移植两部分。牙槽突裂植骨术的时机选择是由患者的年龄及裂隙侧尖牙的牙龄共同决定的，一般是在患儿9～11岁，手术侧恒尖牙未萌，牙根形成2/3（E对）时进行。同时，10岁左右上颌骨发育即已基本完成，可避免手术对上颌骨生长发育的不利影响。在尖牙未萌出前植骨，可使尖牙能通过移植骨区萌出，刺激新骨的形成，增加发育不良的牙槽突裂区域的高度。如果一旦牙已萌出再植骨，则移植骨难以改善牙的牙周支持，同时常因植骨块吸收使牙槽突的高度回复到术前的水平。单侧还是双侧（A错）、裂隙宽度大小（B错）、患者发育情况（C错）、正畸治疗基本完成（D错）是影响牙槽突裂植骨术的因素，而非手术时机的依据。